学习、记忆的电生理学基础是
A. 突触长时程增强电位
B. 识记、保持、再认、回忆
C. 胆碱能神经元动作电位
D. 内流钙离子
E. 经典条件反射

正确答案：A。突触长时程增强电位